治疗颌骨骨折的重要标准是
A. 移位的牙齿恢复正常
B. 恢复正常的咬合关系
C. 血肿消失
D. 骨折线愈合
E. 以上均正确

正确答案：B。恢复正常的咬合关系

解析：本题考查口腔颌面部创伤概论。颌面损伤时牙列的移位或咬合关系错乱，是诊断颌骨骨折的重要体征，而恢复正常的咬合关系（B对）是治疗颌骨骨折的重要标准。